女，54岁。有甲亢的病史，近日因过劳和精神受刺激，而出现失眠，心慌，胸闷。体检：心率160次/分，心电有明显的心肌缺血改变，窦性心律不齐。此时最好选用
A. 胺碘酮
B. 奎尼丁
C. 普鲁卡因胺
D. 普萘洛尔
E. 利多卡因

正确答案：D。普萘洛尔

解析：女，54岁。有甲亢的病史（主因），近日因过劳和精神受刺激，而出现失眠，心慌，胸闷（并发甲状腺毒症心脏病）。体检：心率160次/分，心电有明显的心肌缺血改变（提示心脏缺血，心力衰竭），窦性心律不齐，结合患者的症状、体征和心电图表现，患者考虑诊断甲状腺毒症心脏病，此时最好选用普萘洛尔（D对），其可阻断甲状腺激素对心脏的兴奋作用。胺碘酮（A错）一般用于利多卡因无效的室性心动过速和急诊控制房颤、房扑的心室率。奎尼丁（B错）主要适用于心房颤动或心房扑动经电转复后的维持治疗。普鲁卡因胺（C错）主要用于危及生命的室性心律失常。利多卡因（E错）主要用于治疗室性心律失常，静脉注射适用于因急性心肌梗死、外科手术、洋地黄中毒等所致急性室性心律失常，包括室性早搏、室性心动过速及心室颤动，以及癫痫持续状态用其他抗癫痫药无效者、麻醉等。